男，36岁，已婚。因龟头部赘生物一周就诊，在其龟头及冠状沟部可见数个乳头瘤样小丘疹，表面潮湿柔软，呈污灰色，承认不洁性接触史，醋酸白试验阳性。其最可能的诊断为
A. 尖锐湿疣
B. 扁平湿疣
C. 假性湿疣
D. 生殖器鲍温样丘疹病
E. 阴茎珍珠状丘疹病

正确答案：A。尖锐湿疣

解析：已婚青年男性（性活跃的青年是尖锐湿疣的好发人群），因龟头部赘生物一周就诊，在其龟头及冠状沟部（龟头及冠状沟部等为尖锐湿疣的好发部位）可见数个乳头瘤样小丘疹，表面潮湿柔软，呈污灰色（乳头瘤样小丘疹、质地柔软、疣体常呈白色、粉红色或污灰色为尖锐湿疣的皮损特点），承认不洁性接触史（尖锐湿疣为性传播疾病），醋酸白试验阳性（提示尖锐湿疣的诊断），最可能的诊断为尖锐湿疣（A对）。扁平湿疣（B错）是二期梅毒的皮肤损害，表现为会阴、外生殖器等部位的肉红色或粉红色扁平丘疹或斑块。假性湿疣（C错）常发生在女性小阴唇内侧及阴道前庭，为群集白色或淡红色鱼子大小的光滑丘疹，醋酸白试验阴性。生殖器鲍温样丘疹病（D错）表现为会阴、外生殖器等部位的多个或单个色素性丘疹，肤色、红褐色，大小不等，形状不一，表面可光亮呈天鹅绒外观。阴茎珍珠状丘疹病（E错）表现为男性冠状沟边缘细小圆锥状、排列单行或多行的白色或淡红色小丘疹，醋酸白试验阴性。